能消除牙周袋炎症，增加附着水平的治疗方法
A. 口腔卫生宣教
B. 龈上洁治术
C. 洁治术和根面平整
D. 牙周袋内上药
E. 牙周冲洗

正确答案：C。洁治术和根面平整

解析：本题考查基础治疗的效果与组织愈合。菌斑是牙周病的始动因子，洁治术能去除大部分龈上菌斑和小部分龈下菌斑，根面平整术能去除牙周袋内根面牙石和菌斑，所以通过洁治术和根面平整（C对）彻底去除菌斑有利于增加附着水平。口腔卫生宣教（A错）只能让患者掌握自我菌斑控制方法，清除龈上菌斑，牙周袋内菌斑无法清除，附着水平不会增加。龈上洁治术（B错）只能清除龈上菌斑，同样无法清除牙周袋内菌斑，附着水平不会增加。牙周袋内上药（D错）、牙周冲洗（E错）只能暂时控制牙周炎症，致病因素不去除，附着水平不会增加。